通过坐骨小孔的神经是
A. 闭孔神经
B. 臀上神经
C. 阴部神经
D. 臀下神经
E. 坐骨神经

正确答案：C。阴部神经

解析：闭孔神经（A错）与闭孔血管伴行穿闭膜管出盆腔，随后分为前、后两支，分别在短收肌的前、后方浅出至大腿内侧区。臀上神经（B错）伴臀上血管经梨状肌上孔出盆腔至臀部，行于臀中、小肌之间。阴部神经（C对）伴随阴部血管穿出梨状肌下孔至臀部，随即绕坐骨棘经坐骨小孔进入会阴部的坐骨肛门窝。臀下神经（D错）伴随臀下血管经梨状肌下孔出盆腔至臀部，行于臀大肌深面，发出分支支配该肌。坐骨神经（E错），经梨状肌下孔出盆腔至臀大肌深面。